《温病条辨》所称“辛凉平剂”是指
A. 银翘散
B. 桑菊饮
C. 败毒散
D. 香薷散
E. 止嗽散

正确答案：A。银翘散

解析：本题考查的是方剂的特点。《温病条辨》所称“辛凉平剂”是指银翘散（A对）。桑菊饮是“辛凉轻剂”（B错）。败毒散的特点是扶正不助邪，祛邪不伤正（C错）。香薷散药性偏温，以散寒化湿见长，主治暑令感寒夹湿之证（D错）。止嗽散的特点是温润平和，既能驱邪外出，又不驱邪太过，是以风邪得散，肺气安宁（E错）。